与补钙制剂间时使用时，会与钙离子形成不溶性螯合物，影响补钙剂在体内吸收的抗菌药物有
A. 盐酸多西环素
B. 盐酸美它环素
C. 盐酸米诺环素
D. 盐酸四环素
E. 盐酸土霉素

正确答案：A、B、C、D、E。盐酸多西环素；盐酸美它环素；盐酸米诺环素；盐酸四环素；盐酸土霉素

解析：本题考查四环素类抗菌药。盐酸多西环素（A对）、盐酸美它环素（B对）、盐酸米诺环素（C对）、盐酸四环素（D对）、盐酸土霉素（E对）均为四环素类抗菌药物，为两性化合物，可与钙离子形成不溶性的钙盐，从而影响补钙剂在体内吸收。